CT检查示膀胱肿瘤已浸润膀胱周围脂肪组织，这属于临床分期哪一期
A. Tis
B. T1
C. T2
D. T3
E. T4

正确答案：D。T3